症见壮热，狂躁，声高气粗，腹痛拒按，二便不通者，是指
A. 虚证
B. 实证
C. 虚实夹杂证
D. 真虚假实证
E. 真实假虚证

正确答案：B。实证

解析：壮热，狂躁，声高气粗，为体内有实热；腹痛拒按，二便不通为体内有宿食、燥屎等病理产物蓄积，皆为实证（B对）。虚证指以人体阴阳、气血、津液、精髓等正气亏虚，以“不足、松弛、衰退”为主要症状特征的证（A错）。虚实夹杂证指在同一患者身上，既有虚证，又有实证的情况（C错）。真虚假实证是指疾病的本质为虚证，反出现某些“盛实”的现象（D错）。真实假虚证是指疾病的本质为实证，却出现某些“虚赢”的现象（E错）。